下列关于面神经管段分支分布不正确的是
A. 岩大神经分布于泪腺、鼻、腭黏膜的腺体
B. 镫骨肌神经支配镫骨肌
C. 鼓索分布于舌后1/3味蕾
D. 鼓索分布于下颌下腺的分泌
E. 鼓索分布于舌下腺的分泌

正确答案：C。鼓索分布于舌后1/3味蕾

解析：面神经管段的分支：（1）岩大神经：主要含有副交感节前纤维，其节后纤维分布于泪腺、鼻和腭黏膜的腺体。（2）镫骨肌神经：支配镫骨肌。（3）鼓索：含有两种纤维，即味觉纤维和副交感纤维。分布于舌前2/3的味蕾、下颌下腺及舌下腺的分泌。掌握“面神经、舌咽神经、舌下神经的分支与分布”知识点。